下列哪种细菌在血平皿上形成双溶血环
A. 破伤风梭菌
B. 炭疽杆菌
C. 艰难梭菌
D. 产气荚膜梭菌
E. 肉毒梭菌

正确答案：D。产气荚膜梭菌

解析：本题考查在血平皿上形成双溶血环的细菌。能在血平皿上形成双溶血环的细菌为产气荚膜梭菌（D对）。破伤风梭菌（A错）是破伤风的病原菌，在血平板上，37℃培养48小时后始见薄膜状爬行生长物，伴β溶血。炭疽杆菌（B错）在血琼脂平板上不溶血；在肉汤培养基中由于形成长链而成絮状沉淀生长。艰难梭菌（C错）是人类肠道中正常菌群之一，用环丝氨酸-甘露醇等特殊培养基可从粪便中分离到本菌。肉毒梭菌（E错）可在普通琼脂平板生长，能产生脂酶；在卵黄培养基上，菌落周围出现浑浊圈。